永久性听阈位移包括
A. 听觉适应、听觉疲劳
B. 听觉疲劳、听觉损伤
C. 听觉适应、噪声性耳聋
D. 听力损伤、噪声性耳聋
E. 听觉疲劳、噪声性耳聋

正确答案：D。听力损伤、噪声性耳聋

解析：本题考查永久性听阈位移的种类。永久性听阈位移是指由噪声或其他因素引起的不能恢复到正常听阈水平的听阈升高，包括听力损伤和噪声性耳聋（D对ABCE错）。暂时性听阈位移是指人或动物接触噪声后引起听阙水平变化，脱离噪声环境后，经过一段时间听力可以恢复到原来水平,包括听觉适应和听觉疲劳。